关于描述性研究的叙述，下列哪项是正确的
A. 描述性研究总是设立对照组
B. 生态学研究以个体为单位收集和分析资料
C. 描述性研究最大的优点是直接验证病因假设
D. 现况调查可描述疾病的分布特点，其结果可提供某病的病因线索
E. 抽样调查通常要求进行随机分组

正确答案：D。现况调查可描述疾病的分布特点，其结果可提供某病的病因线索

解析：本题考查描述性研究的分类。描述性研究包括现况研究和生态学研究，现况研究又叫现况调查，包括普查和抽样调查。描述性研究一般是不设立对照组（A错）。生态学研究是以群体为单位收集和分析资料（B错）。描述性研究目的是提出病因假设（C错）。现况研究是通过对特定时点（或期间）和特定范围内人群中的疾病或健康状况和有关因素的分布状况的资料收集、描述，从而为进一步的研究提供病因线索（D对）。抽样调查要遵循随机化原则，不是必要采取随机分组（E错）的方法。